女，40岁。近4年来逐渐出现活动后心悸气短。查体：心尖部可闻及舒张期隆隆样杂音。最有助于确诊的检查是
A. 心电图
B. 超声心动图
C. 胸部X线摄片
D. 心脏核素检查
E. 冠状动脉造影

正确答案：B。超声心动图

解析：患者中年女性，有活动后心悸气短症状，心尖部可闻及舒张期隆隆样杂音（二尖瓣狭窄的特征性杂音），考虑诊断为二尖瓣狭窄。超声心动图（B对）可直接观察瓣膜的活动度，瓣叶的厚度、瓣叶的是否有钙化以及是否合并其他瓣膜的病变等，是临床最有助于确诊的检查。心电图（A错）主要用于心律失常的诊断，二尖瓣狭窄患者虽可见“二尖瓣型P波”，提示左心房扩大，但并无诊断特异性。胸部X线片（C错）为影像学检查，可见肺部淤血和左心房增大等体征，但一般不能用于二尖瓣狭窄的确诊。心脏核素检查（D错）主要用于心肌梗死后判断心肌灌注、心肌存活和心脏功能。冠状动脉造影（E错）主要用于确诊冠心病，对瓣膜狭窄病变无多大诊断意义。